男性，45岁。诉左下颌后牙出现不适6个月求治。口腔检查：左下56残冠，叩诊（±），松动（-），已做过牙髓治疗，牙龈稍红，无法再修复，拟拔除。口内其他牙未见明显异常。X线片示：左下6远中根尖有阴影，距离下颌神经管较近。左下56拔除时断根，颊侧切开去骨后取出，2天后出现激烈疼痛，并向耳颞部、下颌下区放散。口内检查：左下56牙槽窝有腐败变性的残留血凝块，有恶臭。引起疼痛的原因是
A. 下颌神经损伤
B. 干槽症
C. 邻牙损伤
D. 邻牙牙髓炎
E. 牙龈撕裂

正确答案：B。干槽症

解析：本题考查干槽症。本题中取断根时创口较大，拔牙后2天出现剧烈疼痛并向耳颞部、下颌下区放射，下56牙槽窝有腐败变性的残留血凝块，符合干槽症（B对）的诊断标准。下颌神经损伤（A错）后会出现下唇及颏部皮肤不完全性麻木或兼有烧灼、刺痛、蚁走等异样感。邻牙损伤（C错）和牙龈撕裂（E错）都可以在口内检查时发现，且在麻醉效果消失后就可表现出疼痛症状，不会2天后才有症状。急性牙髓炎（D错）表现为自发性阵发性疼痛，夜间疼痛加重，也有放射痛，但是病例中只是为剧烈疼痛，故不考虑邻牙牙髓炎。